抑制蛋白质合成的起始阶段，使核蛋白体分解的药物是
A. 紫杉醇
B. 顺铂
C. 氟尿嘧啶
D. 三尖杉酯碱
E. 放线菌素D

正确答案：D。三尖杉酯碱

解析：本题考查三尖杉酯碱。三尖杉酯碱（D对）能抑制真核细胞蛋白质的合成，使多聚核糖体解聚，干扰蛋白体糖功能。紫杉醇（A错）是抑制细胞有丝分裂阶段。顺铂（B错）是阻碍DNA合成。氟尿嘧啶（C错）通过干扰细胞的代谢过程，导致肿瘤细胞死亡。放线菌素D（E错）是抑制RNA的合成。